川牛膝的功效有
A. 逐瘀通经
B. 利尿通淋
C. 通利关节
D. 强筋健骨
E. 引血下行

正确答案：A、B、C、E。逐瘀通经；利尿通淋；通利关节；引血下行

解析：本题考查川牛膝的功效。川牛膝的功效有逐瘀通经（A对）、利尿通淋（B对）、通利关节（C对）、引血下行（E对）。川牛膝【功效】逐瘀通经，通利关节，利尿通淋，引血下行。仙茅【功效】补肾壮阳，强筋健骨（D错），祛寒除湿。